下列关于人感染高致病性禽流感的措施，哪项属于针对传染源所采取的
A. 对禽类养殖场进行彻底消毒
B. 销毁死禽及禽类废弃物
C. 加强实验室禽流感病毒毒株的管理
D. 避免和患者在无保护状态下密切接触
E. 免疫预防

正确答案：C。加强实验室禽流感病毒毒株的管理